骨平均吸收速度约为每年
A. 0.1mm
B. 0.2mm
C. 0.3mm
D. 0.4mm
E. 0.5mm

正确答案：E。0.5mm

解析：牙槽嵴骨组织改建的程度在拔牙后前3个月内变化最大，6个月时拔牙窝完全愈合，骨吸收速度显著下降，拔牙后2年吸收速度趋缓，平均吸收速度约为每年0.5mm，缺牙时间越长，牙槽嵴吸收越多。掌握“牙列缺失后的病因及影响”知识点。